乳牙常会产生沿牙颈部环绕牙冠的龋蚀称
A. 奶瓶龋
B. 静止龋
C. 猖獗性龋
D. 干性龋
E. 环状龋

正确答案：E。环状龋

解析：本题考查常见患龋类型-环状龋。乳牙常会产生沿牙颈部环绕牙冠的龋蚀称环状龋（E对）。乳牙自身的特点决定了婴幼儿龋在临床上常表现为环状龋，即乳前牙唇面、邻面龋较快发展成围绕牙冠的广泛性的环形龋，呈卷脱状，多见于冠中1/3至颈1/3处。有时切缘残留少许正常的牙釉质、牙本质。环状龋最早由Neuman于1987年报道，在恒牙很少见，多见于乳牙，其原因为：①乳牙新生线矿化薄弱，延伸到牙齿表面的颈部牙釉质部位，往往形成低矿化的区域；②乳牙牙颈部牙釉质，尤其是出生后形成的牙釉质矿化程度低；③在乳牙的牙颈部，局部食物易滞留及自洁作用差，容易导致菌斑的聚集，综上所述在牙颈部易出现龋损。龋病发展到某一阶段时，由于病变环境发生变化，隐蔽部位变得开放，原有致病条件发生了改变，龋病不再继续进行，损害保持原状，这种特殊龋损称为静止龋（B错）。猛性龋（旧称猖獗龋）（C错）是急性龋的一种类型，病程进展很快，多数牙在短期内同时患龋，常见于颌面及颈部接受放射治疗的患者，又称放射性龋。